决定细菌性别的是
A. F因子
B. R质粒
C. Vi质粒
D. Col质粒
E. r决定因子

正确答案：A。F因子

解析：F因子可编码性菌毛，并通过接合方式转移耐药基因。掌握“细菌遗传变异的物质基础及机制”知识点。